亚慢性及慢性毒性试验中，必须观察记录动物饮食情况，每5天称一次体重，了解受试物对动物体重的影响，如各实验组体重减轻并有剂量反应关系，就可以肯定是一种综合毒性效应
A. 称动物体重的目的
B. 食物利用率
C. 症状
D. 脏器系数
E. 一般综合性观察指标

正确答案：A。称动物体重的目的

解析：本题考查称动物体重的目的。亚慢性及慢性毒性试验中，必须观察记录动物饮食情况，每5天称一次体重，了解受试物对动物体重的影响，如各实验组体重减轻并有剂量反应关系，就可以肯定是一种综合毒性效应，这是称动物体重的目的（A对BCDE错）。